下列有关造成牙列缺损的病因，正确的是
A. 牙周病
B. 根尖周病
C. 颌骨疾病
D. 牙槽骨外伤
E. 以上说法均正确

正确答案：E。以上说法均正确

解析：造成牙列缺损的病因包括龋病、牙周病、根尖周病、颌骨和牙槽骨外伤、颌骨疾病、发育障碍等。掌握“牙列缺损病因及影响”知识点。